男，65岁。2周前拔除上颌剩余牙，要求全口义齿修复。检查：上颌牙槽嵴丰满，26和27拔牙窝未完全愈合，拔牙窝颊侧边缘可见明显骨尖，下颌为完整天然牙列，叩痛（-），不松动，牙周状况良好，下颌spee’s曲线曲度大，前部颌间距离约2mm，颌位关系正常。不适用于本患者的义齿设计是
A. 硬质树脂牙
B. 金属（牙合）面牙
C. 腭侧金属基托
D. 腭侧普通树脂基托
E. 腭侧树脂基托加金属网

正确答案：B。金属（牙合）面牙

解析：本题考查单颌全口义齿的修复。男，65岁。2周前拔除上颌剩余牙，要求全口义齿修复。检查：上颌牙槽嵴丰满，26和27拔牙窝未完全愈合，拔牙窝颊侧边缘可见明显骨尖，下颌为完整天然牙列，叩痛（-），不松动，牙周状况良好，下颌spee’s曲线曲度大，前部颌间距离约2mm，颌位关系正常。不适用于本患者的义齿设计是金属（牙合）面牙（B错，为本题的正确答案）。单颌全口义齿的人工牙有塑料牙和瓷牙两类（A对）；金属（牙合）面冠可用于咬合较紧、基牙过短的固定义齿修复；为加强上颌全口义齿基托的强度，可在树脂基托内加金属网，必要时采用金属腭侧基托（CDE对）。